下列关于健康监护论述错误的是
A. 通过健康监护评价劳动条件是否符合劳动卫生标准
B. 通过各种健康检查和分析掌握职工健康状况
C. 是早期发现健康损伤的重要手段
D. 就业前和定期健康检查是健康监护的基本内容之一
E. 目的在于及时发现健康损害，以便采取预防措施

正确答案：A。通过健康监护评价劳动条件是否符合劳动卫生标准

解析：本题考查健康监护。健康监护是通过作业环境评价和医学监护、分析和评价有害因素对接触者健康的影响及其程度，掌握作业者的健康状况（B对）和发现健康损害征象，以便采取相应的预防措施，防止有害因素所致疾患的发生和发展（E对）。健康监护是实现“早期发现、早期诊断、早期治疗”的有效手段（CD对），属于二级预防（A错，为本题正确答案）。